关于沙眼的说法，正确的是
A. 起病急，多为单眼发病
B. 属于非传染性眼病
C. 病原体多为革兰阳性菌
D. 治疗方式以局部用药为主
E. 治疗期间可以佩戴隐形眼镜

正确答案：D。治疗方式以局部用药为主

解析：本题考查沙眼治疗。沙眼主要应用滴眼剂或眼膏治疗，属于局部治疗（D对），严重者需要口服抗生素或外科治疗。一般起病缓慢，多为双眼发病（A错）。沙眼及眼部有感染者切勿配戴隐形眼镜（E错），否则会导致严重后果。